与血液生成及运行关系密切的是
A. 心与肺
B. 心与肾
C. 心与脾
D. 脾与肝
E. 肺与肝

正确答案：C。心与脾

解析：心与脾的关系，主要表现在血液生成与运行方面的相互为用、相互协同（C对）。①血液生成：脾主运化而为气血生化之源，水谷精微经脾转输至心肺，贯于心脉而化赤为血。心主血脉，心生血养脾以维持其运化功能。②血液运行：血液在脉中正常运行，既有赖于心气的推动，又依靠脾气的统摄，心主行血与脾主统血相反相成、协调平衡，维持着血液的正常运行。心与肺的关系主要体现为气与血的关系：心主一身之血，肺主一身之气，两者相互协调，保证气血的正常运行，维持机体各脏腑组织的生理功能。心主血脉，而肺朝百脉，助心行血，是血液正常运行的必要条件；肺司呼吸功能的正常发挥也有赖于心主血脉（A错）。心与肾的关系，主要表现为水火既济、精神互用、君相安位等方面（B错）。肝与脾的关系，主要表现在疏泄与运化的相互为用、藏血与统血的相互协调关系（D错）。肺与肝的关系，主要体现在调节人体气机升降方面（E错）。